有关简化口腔卫生指数的检查方法中，错误的一项是
A. 检查软垢以视诊为主
B. 检查牙石时探针从近中面沿着龈沟向远中移动
C. 视诊困难时可自牙切缘1/3处向颈部轻刮
D. 每个牙面软垢或牙石记分相加，即为个人简化口腔卫生指数
E. 根据软垢面积按标准记分

正确答案：B。检查牙石时探针从近中面沿着龈沟向远中移动

解析：检查方法：检查软垢以视诊为主，根据软垢面积按标准记分，当视诊困难时，可用镰形探针自牙切缘1/3处向颈部轻刮，再根据软垢的面积按标准记分。检查牙石时，将探针插入牙远中面龈沟内，然后沿着龈沟向近中移动，根据牙颈部牙石的量记分。将每个牙面软垢或牙石记分相加，即为个人简化口腔卫生指数。将个人简化口腔卫生指数相加，除以受检人数，即为人群简化口腔卫生指数。掌握“牙周病流行病学及分级预防”知识点。